男孩，7岁，颜面水肿伴尿少10天，肉眼血尿合并腰痛2天，查体：水肿较重，腹胀，移动性浊音阳性，右侧肾区叩击痛阳性。血常规：Hb156g/L，WBC12.6×l0⁹/L，Plt658×10⁹/L。纤维蛋白原6.5g/L，D-二聚体升高明显，血浆白蛋白10g/L，血胆固醇9.56mmol/L，肌酐49umol/L尿常规：蛋白（＋＋），红细胞满视野，畸形率约50%，最可能的诊断是
A. IgA肾病
B. 肾病综合征合并肾静脉血栓形成
C. 肾病综合征合并肾小管功能障碍
D. 急性感染后肾炎合并肾功能不全
E. 肾病综合征合并泌尿道感染

正确答案：B。肾病综合征合并肾静脉血栓形成

解析：患者男性儿童，颜面水肿伴尿少10天，查体水肿明显，实验室检查血浆白蛋白10g/L（﹤30g/L，低白蛋白血症），血胆固醇9.56mmol/L（高脂血症，正常值2.9～6.0mmol/L）易诊断为肾病综合征（NS）。另患儿右侧腰痛，查体肾区叩击痛阳性，实验室检查示Plt658×10⁹/L（升高，正常100～300×10⁹/L），纤维蛋白原6.5g/L，D—二聚体升高明显（以上提示肾静脉血栓形成）。综合患者的临床表现、体征、实验室检查，最可能的诊断为肾病综合征合并肾静脉血栓形成（B对）。IgA肾病（A错）患者起病隐匿 ，常表现为无症状性血尿，伴或不伴蛋白尿，往往体检时发现（P469）。肾病综合征合并肾小管功能障碍（C错）时，患者除表现有大量蛋白尿、低蛋白血症高脂血症等NS表现外，还有夜尿增多，尿钠增加，低比重尿等肾小管损害特征。急性肾炎感染（D错）患者常于链球菌感染后2周左右起病，起病急，主要表现为肉眼血尿，可伴轻中度蛋白尿。合并泌尿道感染患者（E错）会有尿频、尿急、尿痛，排尿不畅等临床表现。